《中国药典》规定，药材检查项下需要控制的物质有
A. 杂质
B. 重金属及有害元素
C. 残留农药
D. 黄曲霉毒素
E. 灰分

正确答案：A、B、C、D、E。杂质；重金属及有害元素；残留农药；黄曲霉毒素；灰分

解析：本题考查的是中药质量标准内容。《中国药典》规定，药材检查项下需要控制的物质有杂质（A对）、重金属及有害元素（B对）、残留农药（C对）、黄曲霉毒素（D对）与灰分（E对）。中药质量标准主要包含真实性鉴定、安全性检查、有效性评价等内容，其检验工作主要以中药质量标准检验通则为依据和方法支持。（一）中药的真实性鉴定是指根据中药原植物（动物、矿物）的形态、药材性状、显微和理化等特征，鉴定其正确的学名和药用部位，并研究其是否符合药品标准的相关规定。中药真实性鉴定的方法主要包括基原鉴定、性状鉴别、显微鉴别和理化鉴别等。（二）中药的安全性检查包括内源性有毒、有害物质及检测与外源性有害物质及检测。1.内源性有毒、有害物质及检测：中药中主要的内源性有毒、有害特质是指中药本身所含的具有毒副作用的化学成分。这些化学成分大多为生物的次生代谢产物，如肾毒性成分的马兜铃酸、肝毒性成分的吡咯里西啶生物碱及具有双重作用的成分等。2.外源性有害物质及检测包括重金属及有害元素、农药残留量、黄曲霉毒素与二氧化硫残留量等。（三）中药的有效性评价包括全草类中药含叶量的检查、浸出物测定与含量测定等。（四）其他检测方法包括传统经验鉴别与纯度鉴别。纯度鉴别：《中国药典》中与纯度相关的检查主要包括杂质检查、水分测定、干燥失重、灰分测定、色度检查、酸败度测定等，并已成为中药质量评价中的常规检查项。